《医疗机构管理条例》规定的医疗机构执业规则是
A. 符合医疗机构的基本标准
B. 按照核准登记的诊疗科目开展诊疗活动
C. 符合区域医疗机构设置规划
D. 能够独立承担民事责任
E. 可进行执业登记

正确答案：B。按照核准登记的诊疗科目开展诊疗活动

解析：根据《医疗机构管理条例》规定，医疗机构应当按照核准登记的诊疗科目开展诊疗活动（B对）。需要改变诊疗科目的，应当按照规定的程序和要求，办理变更登记手续。未经允许不得擅自扩大业务范围。